女，28岁。妊娠2个月，到某大学医院妇产科接受人工流产手术。接诊医师给患者检查时，旁边有10多位男女见习。患者要求见习医学生出去，被接诊医生拒绝。随后医师边操作边给医学生讲解。术后患者质问医师为何示教未事先告知，医师认为患者在医院无隐私，后患者以隐私权被侵犯为由，要求当地卫生行政部门进行处理。基于该案例，该患者就诊期间未被满足的心理需要为
A. 尊重的需要
B. 生理的需要
C. 归属与爱的需要
D. 自我实现的需要
E. 安全的需要

正确答案：A。尊重的需要

解析：本题考查马斯洛需求层次理论。女，28岁。妊娠2个月，到某大学医院妇产科接受人工流产手术。接诊医师给患者检查时，旁边有10多位男女见习。患者要求见习医学生出去，被接诊医生拒绝。随后医师边操作边给医学生讲解。术后患者质问医师为何示教未事先告知，医师认为患者在医院无隐私，后患者以隐私权被侵犯为由，要求当地卫生行政部门进行处理。基于该案例，该患者就诊期间未被满足的心理需要为尊重的需要（A对）。马斯洛，美国人本主义心理学家。在《人的动机理论》中，马斯洛提出了著名的心理需要五层次结构理论。他把人的需要从低级到高级分为生理需要、安全需要、归属与爱的需要、尊重需要和自我实现需要五个层次。根据题目中的信息该患者就诊期间未被满足的心理需要为尊重的需要。